某男，50岁，患泄泻多年，症见肠鸣腹胀，五更泄泻，食少不化，久泻不止，面黄肢冷。证属肾阳不足，宜选用的成药是
A. 理中丸
B. 薯蓣丸
C. 四神丸
D. 启脾丸
E. 河车大造丸

正确答案：C。四神丸

解析：本题考查的是四神丸的主治。患泄泻多年，症见肠鸣腹胀，五更泄泻，食少不化，久泻不止，面黄肢冷。证属肾阳不足，宜选用的成药是四神丸（C对）。四神丸：【主治】肾阳不足所致的泄泻，症见肠鸣腹胀、五更泄泻、食少不化、久泻不止、面黄肢冷。理中丸（A错）：【主治】脾胃虚寒，呕吐泄泻，胸满腹痛，消化不良。薯蓣丸（B错）：【主治】气血两虚，脾肺不足所致的虚劳、胃脘痛、痹病、闭经、月经不调。启脾丸（D错）：【主治】脾胃虚弱，消化不良，腹胀便溏。河车大造丸（E错）：【主治】肺肾两亏，虚劳咳嗽，骨蒸潮热，盗汗遗精，腰膝酸软。